男，25岁。有一天饮一两白酒后出现意识不清，怀疑同饮酒者欲加害于他，言语行为狂暴，将同饮者打伤，数分钟后进入酣睡，醒后完全不能回忆，幼年受过脑外伤。该患者最可能的诊断是
A. 病理性醉酒
B. 遗忘综合征
C. 妄想
D. 脑外伤所致精神障碍
E. 单纯性醉酒

正确答案：A。病理性醉酒

解析：病理性醉酒是指所饮不足以使一般人发生醉酒的酒量而出现明显的行为和心理改变，在饮酒时或其后不久突然出现激越、冲动、暴怒、以及攻击或破坏行为，可造成自伤或伤人后果。病理性醉酒发作时有意识障碍，亦可出现错觉、幻觉和片断妄想。该病例患者有一天饮一两白酒（少量酒）后出现意识不清（意识障碍），怀疑同饮酒者欲加害于他（被害妄想），言语行为狂暴，将同饮者打伤，醒后完全不能回忆，曾幼年受过脑外伤，故诊断为病理性醉酒（A对）。遗忘综合征的患者无意识障碍，与本例不符（B错）。单纯性醉酒是由一次大量饮酒引起的急性中毒，与本例不符（E错）。